下消的中医治法是
A. 清胃泻火，养阴增液
B. 滋阴固肾
C. 清热润肺，生津止渴
D. 益气健脾，生津止渴
E. 滋阴温阳，补肾固摄

正确答案：B。滋阴固肾

解析：下消最常见证型为肾阴亏虚，症状：尿频量多，混浊如脂膏，或尿有甜味，腰膝酸软，乏力，头晕耳鸣，口干唇燥，皮肤干燥、瘙痒，舌红少苔，脉细数。其治法为滋阴固肾。方药：六味地黄丸加减（B对）。清胃泻火，养阴增液适用于中消（胃热炽盛证），代表方为玉女煎（A错）。清热润肺，生津止渴适用于上消（肺热伤津证），方是消渴方（C错）。益气健脾，生津止渴适用于下消（气阴两虚证），代表方是七味白术散（D错）。滋阴温阳，补肾固摄亦适用于（阴阳两虚证），代表方是金匮肾气丸（E错）。